畸形中央尖最常见于
A. 下颌第二双尖牙
B. 上颌第二双尖牙
C. 下颌第一双尖牙
D. 上颌第一双尖牙
E. 上颌侧切牙

正确答案：A。下颌第二双尖牙

解析：本题考查畸形中央尖。畸形中央尖最常见于下颌第二双尖牙（A对）。畸形中央尖多见于下颌前磨牙，尤以第二前磨牙最多见（A对C错），偶见于上颌前磨牙（BD错），常为对称性发生，一般均位于（牙合）面中央窝处，呈圆锥形突起。牙内陷最常见于上颌侧切牙（E错）。